前胡的功效是
A. 降气祛痰
B. 敛肺平喘
C. 清热滑痰
D. 和胃降逆
E. 燥湿化痰

正确答案：A。降气祛痰

解析：本题考查的是前胡的功效。前胡的功效是降气祛痰（A对）。前胡：【功效】降气祛痰，宣散风热。白果：【功效】敛肺平喘（B错），止带缩尿。竹沥：【功效】清热滑痰（C错）。枇杷叶：【功效】清肺止咳，降逆止呕。枇杷叶则兼润肺燥，善治燥咳；又能和胃降逆（D错）止呕，治胃热呕吐。半夏：【功效】燥湿化痰（E错），降逆止呕，消痞散结。